可同时屈手指第2～5指近、远侧指骨间关节的是
A. 指浅屈肌
B. 指深屈肌
C. 蚓状肌
D. 旋前圆肌
E. 骨间肌

正确答案：B。指深屈肌

解析：指浅屈肌（A错）屈第2～5指近侧指骨间关节和掌指关节，屈腕和屈肘。指深屈肌（B对）可同时屈手指第2～5指近、远侧指骨间关节，也可屈腕。蚓状肌（C错）屈第2～5指掌指关节和伸其指骨间关节。旋前圆肌（D错）使前臂旋前，屈肘。骨间肌（E错）包括骨间掌侧肌和骨间背侧肌，前者内收第2、4、5指，屈第2、4、5指掌指关节和伸其指骨间关节，后者固定第3指，外展第2、4指，屈第2～4指掌指关节和伸其指骨间关节。